中国药典规定，用原子吸收分光光度法检查维生素C中的
A. 铁盐
B. 汞盐
C. 铜盐
D. 砷盐
E. 锌盐

正确答案：A、C。铁盐；铜盐